关于头面部浅感觉传导通路描述，错误的是
A. 第一级神经元是三叉神经节细胞
B. 第二级神经元是三叉神经脊束核和脑桥核
C. 第三级神经元是丘脑腹后外侧核
D. 三叉丘系以上受损产生对侧头面部感觉障碍
E. 延髓受损时产生同侧头面部痛温觉障碍，但触觉不受影响

正确答案：C。第三级神经元是丘脑腹后外侧核

解析：头面部浅感觉传导通路中，第1级神经元是三叉神经节细胞（A对），第2级神经元是三叉神经脊束核和脑桥核（B对），第2级神经元发出纤维交叉至对侧组成三叉丘系上行，止于第3级神经元丘脑腹后内侧核（C错，为本题正确答案）。根据上述神经纤维走行特点，可知三叉丘系以上受损产生对侧头面部感觉障碍（D对）；延髓受损时，部分位于延髓的三叉神经脊束核受损，位于脑桥的三叉神经脑桥核则不受影响，故产生同侧头面部痛温觉（脊束核传导）障碍，但触觉（脑桥核传导）不受影响（E对）。